古代医家把医学称为
A. 医术
B. 仁术
C. 人术
D. 技术
E. 艺术

正确答案：B。仁术

解析：医学的发展促进了医德的进步，医学人道主义成为古代医学道德思想形成时期医德发展的主流。儒家的“仁”是其伦理思想的核心，“医乃仁术”（B对）被奉为职业伦理原则，提倡“济世救人”、“爱人、行善、慎独”，强调医生自身的道德修养和自我规范。